男，12岁，1个月前无明显诱因出现左胫骨近端肿痛，逐渐加重，皮肤表面静脉怒张，皮温增高。X线片见左胫骨近端呈溶骨性破坏，可见Codman三角表现。应诊断为
A. 骨巨细胞瘤
B. 骨髓炎
C. 骨结核
D. 骨转移瘤
E. 骨肉瘤

正确答案：E。骨肉瘤

解析：男，12岁（青少年为骨肉瘤好发人群），1个月前无明显诱因出现左胫骨近端肿痛，逐渐加重，皮肤表面静脉怒张，皮温增高（骨肉瘤常见表现）。X线片见左胫骨近端呈溶骨性破坏，可见Codman三角表现（骨肉瘤典型影像学表现），结合患者症状、体征和影像学表现，首先考虑的诊断是右股骨下端骨肉瘤（E对）。骨巨细胞瘤（A错）X线片特征性表现为骨端偏心性、溶骨性、囊性破坏而无骨膜反应，病灶呈肥皂泡样改变。骨髓炎（B错）早期会出现全身中毒症状和局部疼痛。骨结核（C错）多见于脊柱，常有低热盗汗等结核中毒症状，X线可见骨质破坏和椎间隙狭窄。骨转移瘤（D错）通常由其他部位的肿瘤转移到骨头，继发于其他恶性肿瘤。